龋损的前沿位于牙本质的浅层，龋洞形成，且洞内有龋腐，可以诊断为
A. 浅龋
B. 中龋
C. 深龋
D. 静止龋
E. 猛性龋

正确答案：B。中龋

解析：中龋：龋损的前沿位于牙本质的浅层，又称为牙本质浅龋。临床检查时已有明显的龋洞，龋洞内有龋腐。掌握“龋病的诊断及鉴别诊断”知识点。